哺乳期最佳断乳时间是
A. 6个月
B. 8个月
C. 9个月
D. 10个月
E. 12个月

正确答案：B。8个月

解析：哺乳期即产后产妇用自己的乳汁喂养婴儿的时间，就是开始哺乳到停止哺乳的这段时间。哺乳时间一般以8个月为宜，故最佳断乳时间为8个月（B对）。